正常人口服治疗量氯丙嗪后，可出现
A. 心情烦躁
B. 注意力集中
C. 失眠
D. 感情淡漠
E. 以上都正确

正确答案：D。感情淡漠

解析：正常人口服治疗量氯丙嗪后，出现安静、活动减少、感情淡漠和注意力下降、对周围事物不感兴趣、答话缓滞，而理智正常，在安静环境下易入睡，但易唤醒，醒后神态清楚，随后又易入睡。掌握“氯丙嗪”知识点。